在DNA重组实验中使用DNA连接酶的目的是
A. 使DNA片段与载体结合
B. 鉴定重组DNA片段
C. 催化质粒与噬菌体的连接
D. 获得较小的DNA片段
E. 扩增特定DNA序列

正确答案：A。使DNA片段与载体结合

解析：在基因工程中，DNA连接酶可催化DNA中相邻的5＇-磷酸基和3＇-羟基末端之间形成磷酸二酯键，使DNA片段与载体结合（A对）。在鉴定重组DNA片段时（B错），我们一般利用载体本身携带的某种或某些标志基因和目的基因，运用如抗药性标志选择、分子杂交等方法。质粒和噬菌体都属于载体，一般不会催化质粒与噬菌体的连接（C错）。获得较小的DNA片段（D错）需要的是限制性核酸内切酶。扩增特定DNA序列（E错）目前主要利用PCR技术。